服用期间进食高蛋白可阻碍吸收的药品是
A. 格列本脲
B. 硫酸亚铁
C. 维生素D
D. 西咪替丁
E. 左旋多巴

正确答案：E。左旋多巴

解析：本题考查饮食对药物疗效的影响。高蛋白食物在肠内产生大量氨基酸，阻碍左旋多巴（E对）的吸收，使药效降低。格列本脲（A错）为磺酰脲类促胰岛素分泌药物，服药期间进食高蛋白不会阻碍吸收。高蛋白食品能促使胃液大量分泌，从而有利抗贫血药铁剂（B错）的吸收。维生素D（C错）为固醇类衍生物，进食高蛋白食物不会阻碍吸收。西咪替丁（D错）为抑酸剂，同时服用高蛋白食物不会阻碍吸收。